久病体弱的癓瘕患者，其治法是
A. 破瘀散结
B. 理气行滞
C. 先攻后补
D. 攻补兼施
E. 先补后攻

正确答案：D。攻补兼施

解析：体质较弱的癥瘕患者，在患病时正气已不充足，故在攻邪会导致机体虚损，因此要补正气，正气加强与邪气相争，是患病程度加重，对身体造成新的损害。因此，采用攻补兼施（D对）。体质较强的患者，在患病时正气充足，邪气亦过盛，故治疗时可先攻邪气，在此期间会对正气有所耗损，因此要补正气（C错）。破瘀散结多用于体内血行瘀滞，阻滞经脉气血运行所造成的癥瘕，是具体的治则（A错）。理气行滞多用于气滞所导致的癥瘕（B错）。先补后攻无此说法（E错）。